女，56岁。左乳腺癌术后14天，卧床休息为主，解大便时突然大叫，意识丧失。初步诊断为肺动脉栓塞，则栓子最可能来源于
A. 下肢深静脉
B. 冠脉
C. 肱动脉
D. 足背动脉
E. 下肢动脉

正确答案：A。下肢深静脉

解析：该患者乳腺癌术后14天，卧床休息为主（为肺动脉栓塞的继发性危险因素），解大便时突然大叫，意识丧失，根据其病史和临床表现，可初步诊断为肺动脉栓塞，引起PTE的血栓可以来源于下肢静脉径路、上腔静脉径路或右心腔，其中大部分来源于下肢深静脉（A对）。根据血液循环的特点，肺动脉血栓主要来自静脉系统的回流，不会来自动脉或者冠脉（BCDE错）。